山楂的功效是
A. 消食回乳
B. 消食散瘀
C. 消食化痰
D. 消食止痛
E. 消食杀虫

正确答案：B。消食散瘀

解析：本题考查的是山楂的功效。山楂的功效是消食散瘀（B对）。山楂：【功效】消食化积，活血散瘀。麦芽：【功效】消食和中，回乳（A错），疏肝。莱菔子：【功效】消食除胀，降气化痰（C错）。木香：【功效】行气止痛，健脾消食（D错）。使君子：【功效】杀虫消积（E错）。